腹膜为全身面积最大的浆膜，薄而光滑，呈半透明状，壁腹膜和脏腹膜相互移行围成一浆膜腔，称腹膜腔。腹膜有分泌、吸收、支持、固定、修复和防御等功能。腹膜从腹、盆壁移行于脏器或脏器间相互移行形成许多结构，主要有网膜、系膜、韧带和陷凹等。没有系膜的肠管包括
A. 十二指肠
B. 空肠
C. 阑尾
D. 回肠
E. 横结肠

正确答案：A。十二指肠

解析：十二指肠(A对)上无系膜，空肠(B错)和回肠(D错)上有肠系膜，阑尾(C错)上有阑尾系膜，横结肠(E错)上有横结肠系膜。